易引起巨大儿的疾病是
A. 妊娠合并急性病毒性肝炎
B. 妊娠合并糖尿病
C. 尿路感染
D. 妊娠合并心脏病
E. 妊娠合并甲亢

正确答案：B。妊娠合并糖尿病

解析：易引起巨大儿的疾病是妊娠合并糖尿病，因胎儿在母体高胰岛素血症环境中生存，促进蛋白、脂肪合成，抑制脂解，致躯干过度发育（B对）。妊娠合并急性病毒性肝炎对胎儿来说，妊娠早期患有病毒性肝炎，流产、早产、死产的发生率增高，新生儿患病率及死亡率也增高。由于染色体畸变，胎儿畸形率约高2倍（A错）。妊娠期尿路感染容易导致流产（C错）。妊娠合并心脏病由于长期慢性缺氧，致胎儿宫内发育不良和胎儿窘迫（D错）。妊娠合并甲亢易导致流产、早产、低体重或畸形（E错）。